政府出台政策，禁止在加工食品中使用反式脂肪酸，属于
A. 第一级预防
B. 第二级预防
C. 第三级预防
D. 根本预防
E. 三早预防

正确答案：D。根本预防